男，45岁。近一月体重急剧下降，查体可见全身多处淋巴结肿大，肛周生殖器尖锐湿疣，口唇和胸部带状疱疹，口腔黏膜糜烂充血有乳酪状覆盖物。HIV病毒抗体阳性。诊断为“艾滋病”。下列治疗错误的是
A. 营养干预可以改善艾滋病患者生活质量
B. 早期患者不需要使用AZT
C. 造血干细胞移植用于治疗艾滋病费用太高，而且风险过大
D. 免疫调节药物往往由于过敏反应导致其效果短暂或难以肯定
E. 复方新诺明可用于治疗机会感染性疾病卡氏肺囊虫肺炎

正确答案：B。早期患者不需要使用AZT

解析：AZT（叠氮胸苷），又名齐多夫定（ZDV）为选择性抑制HIV反转录酶，掺入正在延长的DNA链中，可抑制其复制。此药为治疗艾滋病一线推荐药品之一，应根据病人身体具体情况考虑治疗方案及是否应用此药，而与是否是早期无关（B错，为本题正确答案）。营养干预可以改善艾滋病患者生活质量（A对）、造血干细胞移植用于治疗艾滋病费用太高，而且风险过大（C对）、免疫调节药物往往由于过敏反应导致其效果短暂或难以肯定（D对）、复方新诺明可用于治疗机会感染性疾病卡氏肺囊虫肺炎（E对）属于正确的治疗。